遗传性牙龈纤维瘤病表现为
A. 龈增生呈细小分叶状、球状
B. 牙龈肿大颜色暗红发绀或苍白，龈缘处组织坏死、溃疡
C. 龈乳头呈球样增生、质软多见于前牙唇侧
D. 增生牙龈覆盖牙冠，质地坚韧，颜色正常或发白
E. 龈肥大、淡粉色，质硬

正确答案：D。增生牙龈覆盖牙冠，质地坚韧，颜色正常或发白

解析：本题考查遗传性牙龈纤维瘤病临床表现。遗传性牙龈纤维瘤病表现为增生牙龈覆盖牙冠，质地坚韧，颜色正常或发白（D对）。遗传性牙龈纤维瘤病增生的牙龈可覆盖部分或整个牙冠，以致妨碍咀嚼，牙齿常因增生的牙龈挤压而发生移位。增生牙龈的颜色正常，组织坚韧，表面光滑，有时也呈颗粒状或小结节状，点彩明显，不易出血。龈增生呈细小分叶状、球状（A错）为牙龈瘤。牙龈肿大颜色暗红发绀或苍白，龈缘处组织坏死、溃疡（B错）为白血病的牙龈病损。龈乳头呈球样增生、质软多见于前牙唇侧（C错）多为妊娠期龈炎。龈肥大、淡粉色，质硬（E错）为药物性牙龈肥大。